医德与医术的关系是
A. 医术是最重要的，有了精湛医术必然有高尚医德
B. 医德是最重要的，有了高尚医德必然有精湛医术
C. 医德与医术没有关系，医德高尚的不一定是医术精湛的
D. 医德与医术没有关系，医术精湛的不一定是医德高尚的
E. 医德与医术密不可分，医学道德以医学技术为依托，医学技术以医学道德为指导

正确答案：E。医德与医术密不可分，医学道德以医学技术为依托，医学技术以医学道德为指导

解析：本题考查医德与医术的关系。医德与医术的关系是医德与医术密不可分，医学道德以医学技术为依托，医学技术以医学道德为指导（E对）。